某男，53岁。癌症放化疗后，外周血白细胞计数3.1x10⁹/L，症见面色㿠白，精神不振，失眠，头昏，倦怠气短，畏寒肢冷，腰际酸楚；舌淡苔薄，脉沉细。诊断为虚劳，宜选用的中成药是
A. 归芪口服液
B. 人参固本丸
C. 十一味参芪胶囊
D. 河车大造丸
E. 补白颗粒

正确答案：E。补白颗粒

解析：本题考查虚劳之阳虚证的常用中成药。诊断为虚劳之阳虚证，宜选用的中成药是补白颗粒（E对）。虚劳之阳虚证【症状】畏寒怕冷，四肢不温，口淡不渴，自汗，小便清长或尿少浮肿，大便溏薄。舌体胖，舌质淡，苔白滑，脉沉迟。【中成药应用】补白颗粒。虚劳之血虚证【症状】头晕眼花，心悸多梦，手足发麻，面色淡黄或淡白无华，口唇、爪甲色淡，妇女月经量少。舌质淡，脉细。【中成药应用】归芪口服液（A错）、再造生血片。虚劳之阴虚证【症状】形体消瘦，口燥咽干，潮热颧红，五心烦热，盗汗，小便短黄，大便干结。舌质红，舌面少津，苔少或无苔，脉细数。【中成药应用】人参固本丸（B错）（大蜜丸）、河车大造丸（D错）。虚劳之气虚证【症状】面色㿠白或萎黄，气短懒言，语声低微，头昏神疲，肢体无力。舌淡，或有齿痕，舌苔薄白，脉虚无力。【中成药应用】十一味参芪胶囊（C错）、参芪十一味颗粒。